以上上皮成分中，能够形成多生牙的为
A. Malassez上皮剩余
B. 牙周袋壁上皮
C. Serres上皮剩余
D. 呼吸道上皮
E. 经瘘道口长入的口腔黏膜的上皮

正确答案：C。Serres上皮剩余

解析：本题考查急慢性根尖周炎。Serres上皮剩余（C对）为残留的牙板细胞，可以形成上皮珠（马牙），可以成为牙源性上皮性肿瘤或囊肿的来源，也可能被重新激活形成多生牙。